下列不属于唾液腺造影术适应证的是
A. 唾液腺导管阳性结石
B. 唾液腺慢性炎症
C. 舍格伦综合征
D. 唾液腺良性肥大
E. 唾液腺肿瘤

正确答案：A。唾液腺导管阳性结石

解析：唾液腺造影术适应证：①唾液腺慢性炎症；②舍格伦综合征；③唾液腺良性肥大；④唾液腺肿瘤；⑤涎瘘；⑥导管阴性结石；⑦确定唾液腺周围组织病变是否累及腺体与导管等。掌握“唾液腺造影技术、CT及MRI”知识点。